上肢血压高于下肢血压，是由于
A. 房间隔缺损
B. 主动脉缺损
C. 主动脉缩窄
D. 室间隔缺损
E. 法洛四联症

正确答案：C。主动脉缩窄

解析：主动脉缩窄多数为先天性，少数是多发性大动脉炎所致。临床表现为上臂血压增高，而下肢血压不高或降低。在肩胛间区、胸骨旁、腋部有侧支循环的动脉搏动和杂音，腹部听诊有血管杂音。胸部X线检查可见肋骨受侧支动脉侵蚀引起的切迹。主动脉造影可确定诊断（C对）。